下列是由局部刺激因素引起的牙周疾病，除外
A. 单纯性龈炎
B. 成年人牙周炎
C. 多发性龈脓肿
D. 龈乳头炎
E. 肥大性龈炎

正确答案：C。多发性龈脓肿

解析：本题考查由局部刺激因素引起的牙周疾病。多发性龈脓肿（C错，为本题的正确答案）是一种比较少见的临床症状较重的牙龈急性炎症，局限于龈乳头，患病前大多已有全口慢性龈炎，当身体抵抗力减低时，局部细菌大量繁殖和病毒毒力增强，便可发生本病，病因尚不明确。单纯性龈炎（A对）是龈缘附近堆积的牙菌斑刺激牙龈导致的。成人牙周炎（B对）是局部的菌斑牙石堆积刺激牙周组织导致的。龈乳头炎（D对）是局部的机械或化学刺激，如食物嵌塞、不适当地使用牙签、充填体悬突、不良修复体等刺激牙龈导致的急性非特异性炎症。肥大性龈炎（E对）是牙龈组织受局部菌斑牙石刺激发生的慢性增生性炎症。